为预防龋齿，向儿童、青少年宣传刷牙方法的正确方法时，应强调重点应刷什么部位
A. 尖牙及其咬合面
B. 切牙及其咬合面
C. 尖牙及其里外面
D. 切牙及其里外面
E. 磨牙及其咬合面

正确答案：E。磨牙及其咬合面